人喝酒后，脉象多
A. 稍浮
B. 稍沉
C. 快而有力
D. 稍弦
E. 稍洪

正确答案：C。快而有力

解析：本题考查的是平脉的特点及变异。人喝酒后，脉象多快而有力（C对）。脉象和人体内外环境的关系十分密切。由于年龄、性别、体质以及精神状态的不同，脉象也会随之发生某些生理性的变化。例如，年龄越小脉率越快，婴儿脉急数，青壮年体强脉多有力，老年人体弱脉来较弱，成年女性较成年男性脉率濡弱而略快。身材高大的人，脉的显现部位较长，矮小的人，显现部位较短。瘦人脉多稍浮（A错），胖人脉多稍沉（B错）。重体力劳动、剧烈运动、长途步行、喝酒、饱食或情绪激动时，脉多快而有力，饥饿时脉来较弱等等。四季的变化对脉象也有一定的影响，如春季脉稍弦（D错），夏季脉稍洪（E错），秋季脉稍浮，冬季脉稍沉等。这些变化在临床诊脉时应注意与病脉鉴别。